牙周膜中最多，在功能上也是最主要的细胞是
A. 成纤维细胞
B. 上皮剩余
C. 成骨细胞
D. 成牙骨质细胞
E. 间充质细胞

正确答案：A。成纤维细胞

解析：成纤维细胞：是牙周膜中最多，在功能上也是最主要的细胞。镜下观察细胞核大，胞质嗜碱性，细胞排列方向与纤维束的长轴平行。功能是合成胶原纤维，此细胞也可以吞噬变性、老化的胶原纤维。因此，该细胞与胶原纤维的合成及吸收有关。掌握“牙周膜”知识点。